根据人群健康效应谱，从弱到强的5级效应的分布规律是
A. 两头大，中间小
B. 两头小，中间大
C. 最弱的效应比例大
D. 最强的效应比例大
E. 都一样大

正确答案：C。最弱的效应比例大

解析：本题考查人群健康效应谱的相关内容。根据人群健康效应谱，从弱到强的5级效应的分布规律是：最严重的效应是死亡，所占比例很少；最弱的效应所占比例最大（C对ABDE错）。